国外有关药物警戒信息中提高剂量VB₆可致
A. 成年后易发阴道癌
B. 心脏毒性
C. 皮肤反应
D. 心血管反应
E. 周围神经炎

正确答案：E。周围神经炎

解析：本题考查药物不良反应。国外有关药物警戒信息中提高剂量VB₆可致周围神经炎（E对）。